下列大气污染物中，属于二次污染物的是
A. 氟化物
B. 多环芳烃
C. 一氧化碳、二氧化碳
D. 光化学烟雾
E. 二氧化硫、铅

正确答案：D。光化学烟雾

解析：本题考查二次污染物。二次污染物是指某些一次污染物进入环境后在物理、化学或生物学作用下，或与其他物质发生反应而形成与初始污染物的理化性质和毒性完全不同的新的污染物，如光化学烟雾（D对ABCE错）。